在第二代抗精神病药物中最易出现锥体外系不良反应的药物是
A. 舒必利
B. 氯氮平
C. 利培酮
D. 奥氮平
E. 喹硫平

正确答案：C。利培酮